拔除上中切牙时，用力应首先使用
A. 楔的原理
B. 杠杆原理
C. 轮轴原理
D. 切割力
E. 扭转力

正确答案：E。扭转力

解析：本题考查上颌中切牙拔除术。拔除上中切牙时，用力应首先使用扭转力（E对）。上颌中切牙牙根较直，近圆锥形单根，唇侧牙槽骨弹性较愕侧大且壁薄。拔除时应先作扭转动作，如较牢固应配合适度的摇动，一定程度地松动后作直线牵引即可拔出。根挺及根尖挺主要使用的是轮轴原理、楔的原理及杠杆原理组合性动作（AB错），以达到高效、低创伤的效果。三角挺的设计主要依据是轮轴原理（C错）。切割力（D错）一般用于多根牙的分牙拔除，可缩短时间，减少创伤。